病情随体质而发生的转化称为
A. 质势
B. 病势
C. 从化
D. 易感性
E. 传变

正确答案：C。从化

解析：病情随体质发生变化，称为从化（C对）。由于体质的特殊性，不同的体质类型有其潜在的、相对稳定的倾向性，可称为“质势”（A错）。人体遭受致病因素的作用时，即在体内产生相应的病机变化，而且不同的致病因素具有不同的病变特点，这种病机变化趋势成为“病势”（B错）。传变，指疾病在机体脏腑经络组织中的传移和变化（E错）。